慢性肺心病肺心功能代偿期的表现中，下述选项错误的是
A. 干、湿啰音提示支气管内有感染
B. 肺动脉第二音亢进提示肺动脉高压
C. 三尖瓣区听到收缩期杂音提示右心肥厚
D. 剑突下出现收缩期搏动提示左心肥厚
E. 颈静脉充盈提示胸腔内压升高并非都有心衰

正确答案：D。剑突下出现收缩期搏动提示左心肥厚

解析：慢性肺心病肺心功能代偿期的表现中，表现肺、胸基础疾病的症状，急性感染可使上述症状加重，干、湿啰音提示支气管内有感染（A对），除可见肺、胸疾病的体征外，尚可见肺动脉高压和右室扩大的体征，如P₂＞A₂ （B对），三尖瓣区出现收缩期杂音，剑突下心脏搏动增强，提示有右心室肥厚（C对D错），部分患者因肺气肿使胸腔内压升高，阻碍腔静脉回流，可有颈静脉充盈，呼气期尤为明显，吸气期充盈减轻；此期肝下界下移是由膈肌下降所致，不要误认为是右心衰竭的表现（E对）。